男，58岁，右颊黏膜出现一白色斑块，均质状，不能被擦去，触诊无明显疼痛，涂片镜检三次未找到芽孢或菌丝，右下3456为不良修复体，无吸烟、酗酒史，治疗措施不妥者是
A. 去除不良修复体
B. 口服维生素A
C. 0.2％维甲酸局部涂擦
D. 硝酸银局部处理白色斑块，以促进斑块消退
E. 定期随诊，如出现恶变指征，可考虑早期手术切除

正确答案：D。硝酸银局部处理白色斑块，以促进斑块消退

解析：本题考查口腔白斑病的疾病管理。口腔白斑病是发生于口腔黏膜上以白色为主的损害，白色斑块不能被擦去，好发于40岁以上的中老年男性，患者无烟酒嗜好，右下3456为不良修复体，且右侧唇红部有一不能被擦去的均质状白色斑块，涂片镜检3次未找到芽胞或菌丝，排除念珠菌病，尤其是增值型、红斑型，据此可判断患者所患疾病为口腔白斑病。因硝酸银对软组织有较强的腐蚀性，故不能用硝酸银局部处理白色斑块（D错，为本题正确答案）。治疗口腔白斑病应去除其刺激因素，如戒烟酒、停止咀嚼槟榔、去除残根残冠、去除不良修复体（A对）等。口服维生素A（B对）能保持上皮组织的正常功能，可使症状得到改善。此外维甲酸具有促进上皮细胞增生分化及较明显的角质溶解作用，防止上皮过角化，因而常使用0.2％维甲酸局部涂擦（C对）牙龈或唇颊粘膜来治疗白斑病。对有癌变倾向的病损，应严密复查，定期随访，如出现恶变指征，可考虑早期手术切除（E对）。